Rahe的社会再适应量表测量某人的生活事件，LCU总分为250，预示以后两年内患心身疾病的概率为
A. 无可能性
B. 0.3
C. 0.5
D. 0.7
E. 1

正确答案：C。0.5